“亚硝酸钠-硫代硫酸钠”疗法：立即将亚硝酸异戊酯1～2支包在手帕或纱布内弄碎，给患者吸入15～30秒，每隔3分钟重复1次。接着静脉缓慢注射3%亚硝酸钠10～15ml，随即用同一针头缓慢静脉注射硫代硫酸钠20～50ml。使用上述疗法可在体内快速形成
A. 血红蛋白
B. 高铁血红蛋白
C. 亚铁血红蛋白
D. 氧合血红蛋白
E. 碳氧血红蛋白

正确答案：B。高铁血红蛋白